评价消毒灭菌是否彻底的指标是破坏
A. 荚膜
B. 芽胞
C. 鞭毛
D. 菌毛
E. 异染颗粒

正确答案：B。芽胞